横骨上廉至内辅骨上廉的骨度分寸是
A. 12寸
B. 13寸
C. 16寸
D. 18寸
E. 19寸

正确答案：D。18寸

解析：横骨上廉为耻骨联合上缘，内辅骨上廉为股骨内上髁上缘，两者间定为18寸，用于确定下肢内侧足三阴经穴的纵向距离（D对）。12寸为肘横纹（平肘尖）至腕掌（背）侧横纹的距离（A错）。13寸为胫骨内侧髁下方至内踝尖的距离（B错）。16寸为腘横纹至外踝尖的距离（C错）。19寸为股骨大转子至腘横纹的距离（E错）。